与右淋巴导管无关的是
A. 右上肢的淋巴
B. 右侧头、颈部的淋巴
C. 右肺
D. 注入右静脉角
E. 肝

正确答案：E。肝

解析：右上肢的淋巴（A对）、右侧头、颈部的淋巴（B对）、右肺的淋巴（C对）均为右淋巴导管收集。右淋巴导管注入右静脉角（D对）。肝（E错，为本题正确答案）的淋巴引流与右淋巴导管无关。